根治舌下腺囊肿的方法是
A. 抽出囊液
B. 抽出囊液，注入2%碘酊
C. 摘除囊肿
D. 切除舌下腺
E. 行袋形缝合术

正确答案：D。切除舌下腺

解析：根治舌下腺囊肿的方法是切除舌下腺，残留部分囊壁不致造成复发。对于口外型舌下腺囊肿，可全部切除舌下腺后，将囊腔内的囊液吸净，在下颌下区加压包扎，而不必在下颌下区做切口摘除囊肿。掌握“舌下腺及唾液腺黏液囊肿”知识点。